手少阳三焦经经分布在
A. 上肢外侧中线
B. 上肢外侧后缘
C. 上肢内侧后缘
D. 上肢外侧前缘
E. 上肢内侧后缘

正确答案：A。上肢外侧中线

解析：十二经脉在四肢部的分布规律：手经行于上肢，足经行于下肢；阴经行于内侧面，阳经行于外侧面。按正立姿势，两臂自然下垂拇指向前的体位描述：手足阴经为太阴在前缘、厥阴在中线少阴在后缘；手足阳经为阳明在前缘、少阳在中线、太阳在后缘；足厥阴肝经有例外，即内踝尖上八寸以下为厥阴行于前，太阴行于中，少阴仍在后。根据此规律，手经行于上肢，阳经行于外侧，少阳在中线（A对）。